珍珠的功效有
A. 养心安神
B. 解毒敛疮
C. 祛风明目
D. 安神定惊
E. 明目除翳

正确答案：B、D、E。解毒敛疮；安神定惊；明目除翳

解析：本题考查珍珠的功效。珍珠的功效有解毒敛疮（B对）、安神定惊（D对）、明目除翳（E对）。珍珠【功效】安神定惊，明目除翳，解毒敛疮，润肤祛斑。酸枣仁【功效】养心安神（A错），敛汗。蒺藜【功效】平肝，疏肝，祛风明目（C错），散风止痒。